可用于艾滋病辅助诊断的免疫细胞是
A. B淋巴细胞
B. 树突状细胞
C. NK细胞
D. 巨噬细胞
E. T细胞

正确答案：E。T细胞

解析：HIV主要侵犯人犯人体免疫系统，包括CD4⁺T淋巴细胞检测、巨噬细胞和树突状细胞，主要表现为CD4⁺T淋巴细胞数量不断减少，导致免疫功能缺陷。引起各种机会性感染和肿瘤的发生。CD4⁺T淋巴细胞检测（E对）HIV特异性侵犯CD4⁺T淋巴细胞，CD4淋巴细胞进行性减少，CD4⁺/CD8⁺比例倒置。采用流式细胞术检测CD4T淋巴细胞绝对数量，可以了解HIV感染者机体免疫状况和病情进展，确定疾病分期和治疗时机，判断治疗效果和临床合并症。因此，T细胞可用于艾滋病辅助诊断。B淋巴细胞（A错）可用于白血病的辅助诊断。树突状细胞（B错）、NK细胞（C错）、巨噬细胞（D错）均不能用于艾滋病辅助诊断。